可致光敏反应的抗菌药物的是
A. 克林霉素
B. 美罗培南
C. 阿米卡星
D. 头孢哌酮
E. 莫西沙星

正确答案：E。莫西沙星

解析：本题考查药物的不良反应。莫西沙星（E对）为氟喹诺酮类抗菌药物，具有光毒性。克林霉素（A错）为林可霉素类抗菌药物，无光敏反应。美罗培南（B错）为碳青霉烯类药物，无光敏反应。阿米卡星（C错）为氨基糖苷类抗菌药物，其不良反应是耳毒性。头孢哌酮（D错）是头孢菌素类抗菌药物，无光敏反应。